淋巴细胞活化过程中需要黏附分子的辅佐，其中协助Th活化B细胞的是
A. CD2/LFA3
B. CD40/CD40L
C. LFA-1/ICAM-1
D. CD4/MHCⅡ类分子
E. CD8/MHCⅠ类分子

正确答案：B。CD40/CD40L